“重阴必阳”的理论依据是
A. 阴阳交感
B. 阴阳对立制约
C. 阴阳转化
D. 阴阳互根互用
E. 阴阳消长

正确答案：C。阴阳转化

解析：重阴必阳是指阴气亢盛到一定程度，会引起质变，向其对立的阳气方面转化。阴阳交感是指阴阳二气在运动中处于相互感应，即不断影响、相互作用的过程之中。阴阳交感是导致事物发生、发展和变化的前提（A错）。阴阳的对立制约指的是相互对立的阴阳双方，大多存在着相互抑制和约束的特性。阴阳对立制约体现了对立事物或现象的调控作用，从而表现出事物间具有错综复杂的动态联系（B错）。阴阳转化是指事物或现象的阴阳属性，在一定条件下，可以向其对立面转化。即是说阴阳两方面的消长运动发展到一定的阶段，其消长变化达到一定的阈值，就可能导致阴阳属性的转化，即阴可以转化为阳，阳也可以转化为阴。阴阳转化是在消长运动量变基础上的质变过程（C对）。阴阳互根互用是指事物或现象中相互对立的阴阳两个方面，具有相互依存、相互为用的关系。阴阳互根互用是说阴和阳任何一方都不能脱离对方而单独存在（D错）。阴阳消长是事物或现象对立制约、互根互用的阴阳两个方面不是处于静止状态，而是处于运动变化之中。阴阳消长是在对立制约、互根互用基础上变现出的量变过程，未出现质变（E错）。